机体对慢性Ⅱ型呼吸衰竭所进行的代偿性反应是
A. 血钾增加
B. 阴离子间隙增加
C. 肾脏回吸收碳酸氢根增加
D. 呼吸频率增加
E. 潮气量增加

正确答案：C。肾脏回吸收碳酸氢根增加

解析：慢性Ⅱ型呼吸衰竭时，伴有低氧血症和高碳酸血症，体内处于酸中毒的状态，机体为维持pH恒定，肾脏回吸收碳酸氢根增加（C对）。血钾增加（A错）为呼吸性酸中毒导致的结果，不是代偿性反应，因为呼吸性酸中毒时，由于能量不足，体内转运离子的钠泵功能障碍，使细胞内钾转运至血液，造成高钾血症。阴离子间隙（B错）正常值为8～16，增大常表示有代谢性酸中毒，Ⅱ型呼吸衰竭常表现为呼吸性酸中毒。Ⅱ型呼吸衰竭时，体内严重CO₂潴留，使呼吸中枢受到抑制，不会出现呼吸频率增加（D错）和潮气量增加（E错）。